主要用于疟疾预防的药物是
A. 氯喹
B. 甲硝唑
C. 乙胺嘧啶
D. 吡喹酮
E. 伯氨喹

正确答案：C。乙胺嘧啶

解析：本题考查氯喹。主要用于疟疾预防的药物是乙胺嘧啶（C对）。乙胺嘧啶对恶性疟及良性疟的原发性红外期疟原虫有抑制作用，是用于病因性预防的首选药。氯喹（A错）为主要用于控制疟疾症状的抗疟药。甲硝唑（B错）为抗阿米巴病药。吡喹酮（D错）为抗血吸虫病药。伯氨喹（E错）为主要用于控制复发和传播的抗疟药。